15岁男孩，身材矮小，智力正常。可以断定他不是
A. 家族性矮身材
B. 体质性生长迟缓
C. 垂体性侏儒症
D. 甲状腺功能减低
E. 营养不良

正确答案：D。甲状腺功能减低